五年更新一次的是
A. 某省中药饮片炮制规范
B. 局颁标准
C. 药品注册标准
D. 《中国药典》

正确答案：D。《中国药典》

解析：本题考查药典标准的主要类别。每隔5年修订颁布、具有法律地位且为国家药品标准的是《中国药典》（D对）。《中国药典》：由国家药典委员会组织编纂，国家药品监督管理部门批准并颁布。《中国药典》是国家药品标准的核心，是具有法律地位的药品标准，拥有最高的权威性。从1985年起每5年修订颁布新版药典。《药品管理法》规定，中药饮片应当按照国家药品标准炮制；国家药品标准没有规定的，应当按照省（区、市）人民政府药品监督管理部门制定的炮制规范炮制（A错）。国家药品监督管理部门颁布的其他药品标准：为了促进药品生产，提高药品质量和保证用药安全，除《中国药典》收载的国家药品标准外，尚有《国家食品药品监督管理局国家药品标准》（简称“局颁药品标准（B错）”，或“局颁标准”），也收载了国内已有生产、疗效较好，需要统一标准但尚未载人药典的品种质量标准。药品注册标准：（C错）药品注册标准是指国家药品监督管理部门核准给申请人特定药品的质量标准。